在饮水氟含量过高，有地氟病流行的地区，几岁以下儿童不建议使用含氟牙膏刷牙
A. 2岁
B. 3岁
C. 4岁
D. 5岁
E. 6岁

正确答案：E。6岁

解析：本题考查氟化物与龋病的预防。含氟牙膏的使用和防龋效果：对于6岁以上的儿童和成人，每天用含氟浓度高于1000mg/kg的牙膏刷牙2次，每次用量约1g，可达到有效的预防效果。3～6岁的儿童，每次牙膏用量约为“豌豆”大小，同时，应在家长监督与指导下使用，以免儿童过多的吞咽牙膏，导致产生氟牙症的危险。在饮水氟含量过高，有地氟病流行的地区，6岁以下（E对）的儿童不推荐使用含氟牙膏。注意题目问的是在高氟地区。